下列中药中呈黄棕色粉末状，置手中易从指缝滑落的药材是
A. 儿茶
B. 芦荟
C. 血竭
D. 海金沙
E. 青黛

正确答案：D。海金沙

解析：本题考查的是海金沙药材的性状鉴别。下列中药中呈黄棕色粉末状，置手中易从指缝滑落的药材是海金沙（D对）。海金沙：【性状鉴别】药材呈粉末状，棕黄色或浅棕黄色。体轻，手捻有光滑感，置手中易由指缝滑落。气微，味淡。将海金沙粉末撒在水中则浮于水面，加热始逐渐下沉；将其少量撒于火上，即发出轻微爆鸣及明亮的火焰。儿茶（A错）：【性状鉴别】药材呈方形或不规则块状，大小不一。表面棕褐色或黑褐色，光滑而稍具光泽。质硬，易碎，断面不整齐，具光泽，有细孔，遇潮有黏性。气微，味涩、苦，略回甜。取火柴杆浸于本品水浸液中，使轻微着色，待干燥后，再浸入盐酸中立即取出，置火焰附近烘烤，杆上即显深红色。芦荟（B错）水溶液与硼砂共热，所含芦荟素即起反应，显黄绿色荧光。血竭（C错）：【性状鉴别】药材略呈类圆四方形或方砖形，表面暗红色，有光泽，附有因摩擦而成的红粉。质硬而脆，破碎面红色。研粉为砖红色。气微、味淡。在水中不溶，在热水中软化。本品粉末，置白纸上，用火隔纸烘烤即熔化，但无扩散的油迹，对光照视呈鲜艳的红色。以火燃烧则产生呛鼻的烟气。青黛（E错）：【性状鉴别】药材为深蓝色的粉末，体轻，易飞扬；或呈不规则多孔性的团块、颗粒，用手搓捻即成细末。微有草腥气，味淡。取本品少量，用微火灼烧，有紫红色烟雾发生。取本品少量，滴加硝酸，产生气泡并显棕红色或黄棕色。